不升高灭菌产品的温度，穿透性强，适用于不耐热药物灭菌的方法是
A. 低温间歇灭菌法
B. 干热空气灭菌法
C. 辐射灭菌法
D. 紫外线灭菌法
E. 微波灭菌法

正确答案：C。辐射灭菌法

解析：本题考查注射剂的灭菌方法。注射剂的灭菌法有：（1）物理灭菌法：湿热灭菌法，如热压灭菌法；干热灭菌法，如火焰灭菌法；射线灭菌法，如辐射灭菌法；滤过灭菌法；（2）化学灭菌法：气体灭菌法、化学药剂灭菌法；（3）无菌操作法。其中辐射灭菌法（C对）是以放射性同位素（Co）放射的γ射线杀菌，不升高灭菌产品的温度，穿透力强，适合于不耐热药物的灭菌。